定喘汤的组成药物中含有
A. 半夏、当归
B. 麻黄、杏仁
C. 桑白皮、地骨皮
D. 黄芩、陈皮
E. 苏子、橘红

正确答案：B。麻黄、杏仁

解析：定喘汤组成为白果、麻黄、苏子、甘草、款冬花、杏仁、桑皮、黄芩、半夏（定喘白果与麻黄，款冬半夏白皮桑，苏杏黄芩兼甘草，外寒痰热哮喘尝）（B对）。